诊断新生儿ABO溶血，最重要的检查是
A. 血常规
B. 血型
C. 肝功能与胆红素
D. 改良直接抗人球蛋白试验
E. 血涂片查红细胞形态

正确答案：D。改良直接抗人球蛋白试验

解析：新生儿ABO溶血是由母婴血型不合引起的抗原抗体反应，当胎儿红细胞通过胎盘进入母体或者母体通过输血、接种等途径接触其它血型抗原时，刺激母体产生相应抗体，当此抗体（IgG）进入胎儿循环时，可致敏胎儿红细胞（形成抗体-胎儿RBC复合物），继而在单核-吞噬细胞内被破坏，引起溶血。而改良直接抗人球蛋白试验（Coombs实验）正是利用该原理，监测红细胞是否已经致敏，故其为最重要的实验（D对）。溶血时，血常规（A错）的贫血表现（红细胞数量和血红蛋白减少）、母婴血型（B错）不合、肝功与胆红素测定（C错）（血清胆红素和非结合胆红素明显升高）、血涂片（红细胞残影和红细胞碎片）（E错）均有助于诊断ABO溶血，但不能确诊。